男婴，生后20小时出现黄疸，母亲血型为O型。有确诊意义的检查是
A. 胆红素测定
B. 血型测定
C. 网织红细胞计数
D. 抗体释放试验
E. 血清游离抗体测定

正确答案：D。抗体释放试验

解析：在24小时内该患儿出现黄疸，说明为病理性黄疸。另外母亲血型为O型，应考虑为新生儿ABO血型不合引起的溶血性黄疸。选项中对ABO血型不合引起的溶血性黄疸有诊断意义的是抗体释放试验（D对）。胆红素测定仅仅能用来检测肝脏处理非结合胆红素的功能（A错）。血型测定只能用于筛查，没有诊断价值（B错）。网织红细胞计数对贫血有辅助诊断的价值，对溶血性黄疸没有作用（C错）。血清游离抗体测定有助于估计是否继续溶血、换血后的效果，但不是确诊试验（E错）。